促使NK细胞转化为LAK细胞的是
A. IL-4
B. IL-2
C. IL-3
D. IFN-α
E. IL-10

正确答案：B。IL-2

解析：本题考查NK细胞转化为LAK细胞。促使NK细胞（自然杀伤细胞）转化为LAK细胞（淋巴因子激活的杀伤细胞）的是IL-2（B对）。